在使用药物进行治疗的过程中，医生恰当的做法是
A. 使用能为医院和医生带来较高回报的药物
B. 药物使用与选择是医生的权利，不用征求患者的意见
C. 为了尽快取得效果，加大药物剂量
D. 按需用药，考虑效价比
E. 联合使用多种药物，力求最佳效果

正确答案：D。按需用药，考虑效价比

解析：医务人员进行药物治疗时应遵循的伦理要求包括以下方面：对症下药，因人施治；合理配伍，适时调整；药以致用，药尽其用；忠于职守，从严管理（D对）。医生在应用药物治疗患者时应当以患者为中心，从患者的身体、心理、经济角度衡量处方以求患者利益最大化，而不是为医院牟利（A错）。药物的使用应当适度考虑患者个人情况。征求患者意见（B错）。由于药物的两重性，医务人员在用药时要发挥其有利的治疗作用，尽量减少和避免不良反应。单种药物能治好的疾病就不联合用药，必须联合用药或使用毒副作用大的药物要根据药理性能合理配伍，以提高抗病能力，克服和对抗一些药物的毒副作用，从而使药物发挥更大的疗效（CE错）。